患者，女，34岁，已婚。4年前因患子宫肌瘤自然流产1次，现妊娠43天，阴道不时少量下血，腰酸，胎动下坠，口干不欲饮，舌暗红，脉沉弦。其证候是
A. 跌仆伤胎
B. 气虚
C. 肾虚
D. 血虚
E. 癥瘕伤胎

正确答案：E。癥瘕伤胎

解析：题中患者妊娠43天，阴道不时少量下血，腰酸，胎动下坠，故诊断为胎动不安。患者4年前因患子宫肌瘤自然流产1次，体内有瘀血留滞，日久结为癥积，现怀孕，胎居子宫，癥积瘀血碍其生长，胎元不固，故阴道不时少量下血，腰酸，胎动下坠。口干不欲饮为瘀血内阻，津液失于输布，而体内津液本不亏乏所致。舌暗红，脉沉弦为瘀血之象，故辨为血瘀证。患者孕期并无跌仆闪挫发生（A错）。气虚者多小腹空坠，气短，神疲等症状（B错）。肾虚多伴头晕耳鸣，夜尿多等症状（C错）。血虚多伴面色淡白，心悸，神疲等症状（D错）。患者4年前因患子宫肌瘤自然流产1次，体内有瘀血流滞，日久结为癥积，现癥瘕伤胎而致题中症状（E对）。